胰腺炎的手术指征
A. 胰腺周围组织坏死感染
B. 急性腹膜炎
C. 血钙持续低于2.25mmol/L
D. 胆囊炎
E. 早期休克

正确答案：A。胰腺周围组织坏死感染

解析：胰腺炎的手术指征包括①急性腹膜炎不能排除其他急腹症时（B错）；②伴胆总管下端梗阻或胆道感染者（D错）；③合并肠穿孔、大出血或胰腺假性囊肿；④胰腺和胰周坏死组织继发感染（A对）。血钙持续低于2.25mmol/L（C错）提示预后不良，不属于手术指征。早期休克（E错）提示重症胰腺炎。